修复前对多根牙根分叉病变较轻时的患牙应
A. 观察
B. 拔除患牙
C. 不做处理
D. 根管治疗术
E. 采取相应措施

正确答案：E。采取相应措施

解析：多根牙根分叉病变较轻时，通过龈上洁治、龈下刮治、牙龈切除术或牙龈成形术以及保持良好的口腔卫生等措施，能够有效地控制其病变且预后较好。掌握“修复前准备”知识点。